成人内服朱砂的一日剂量是
A. 0.1～0.5g
B. 0.3～1g
C. 1.1～3g
D. 3～6g
E. 6～10g

正确答案：A。0.1～0.5g

解析：本题考查的是朱砂的用法用量。成人内服朱砂的一日剂量是0.1～0.5g（A对）。朱砂：【用法用量】内服：研末冲，或入丸散，0.1～0.5g；不入煎剂。外用：适量，干掺，或调敷，或喷喉。决明子：【用法用量】内服：煎汤，10～15g，打碎。研末，每次3～6g（D错）。降血脂或治热结肠燥便秘可用至30g。生用清肝明目、润肠通便力较强。炒用药力略减，临床也常用。射干：【用法用量】内服：煎汤，6～10g（E错）；入丸散。外用：适量，研末吹喉，或外敷。用法用量为0.3～1g（B错）或1.1～3g（C错）的中药，2022年考试指南未明确说明。